磺胺甲噁唑的含量测定方法为
A. 在稀盐酸溶液中，用亚硝酸钠滴定液滴定，永停法指示终点
B. 在碳酸钠溶液中，用硝酸银滴定液滴定，电位法指示终点
C. 用0.4%的氢氧化钠溶液溶解，在304nm处测定吸收度
D. 用中性乙醇溶解，用氢氧化钠滴定液滴定，酚酞作指示剂
E. 用冰醋酸溶解，用高氯酸滴定液滴定

正确答案：A。在稀盐酸溶液中，用亚硝酸钠滴定液滴定，永停法指示终点

解析：本题考查含量测定。磺胺甲噁唑的含量测定方法为在稀盐酸溶液中，用亚硝酸钠滴定液滴定，永停法指示终点（A对）。磺胺甲噁唑为芳香伯胺类药物，在盐酸存在下，能定量地与亚硝酸钠产生重氮化反应。在碳酸钠溶液中，用硝酸银滴定液滴定，电位法指示终点（B错）可用来测定苯巴比妥。用0.4%的氢氧化钠溶液溶解，在304nm处测定吸收度（C错）可用来测定硫喷妥钠。用中性乙醇溶解，用氢氧化钠滴定液滴定，酚酞作指示剂（D错）可测阿司匹林。用冰醋酸溶解，用高氯酸滴定液滴定（E错）可用来测定有机弱酸及其盐类。